孕期用药是否导致胎儿畸形的影响因素主要为
A. 胎儿性别
B. 胎儿孕龄
C. 孕母血压
D. 孕母并发症
E. 多胎

正确答案：B。胎儿孕龄

解析：本题考查导致胎儿畸形的影响因素。药物对不同妊娠时期的影响最严重的药物毒性是影响胚胎分化和发育，导致胎儿畸形和功能障碍，与用药时的胎儿孕龄（B对ACDE错）密切相关。